铅中毒时尿中δ-ALA的增加是由于
A. 铅抑制细胞三磷酸腺苷酶
B. 铅抑制含巯基酶
C. 铅抑制δ-氨基乙酰丙酸脱水酶（ALAD）
D. 铅激活δ-氨基乙酰丙酸脱水酶（ALAD）
E. 铅抑制粪卟啉原氧化酶

正确答案：C。铅抑制δ-氨基乙酰丙酸脱水酶（ALAD）

解析：本题考查铅中毒对机体影响。当机体接触铅时，可抑制δ-氨基-γ-酮戊酸脱水酶活性（C对ABDE错）和血红素合成酶活性，表现为尿δ-氨基-γ-酮戊酸含量和血中锌原卟啉水平增加。因此尿δ-氨基-γ-酮戊酸含量可作为反映毒作用的指标。